下列是牙源性角化囊肿易复发的原因，除了
A. 囊壁薄
B. 可能存在多发病灶
C. 同一病灶内有多个囊腔
D. 可能存在子囊
E. 囊肿内有角化物

正确答案：E。囊肿内有角化物

解析：本题考查牙源性角化囊肿易复发的原因。囊内黄白色的片状物或干酪样物质不含有肿瘤细胞，不具有增殖能力（E错，为本题的正确答案）。牙源性角化囊性瘤囊壁薄（A对），可能形成多发病灶（B对），同一病灶内有多个囊腔（C对）或子囊（D对），易引起复发。